在病例对照研究中，匹配过头会造成
A. 降低研究效率
B. 提高研究效率
C. 对研究效率无影响
D. 无法估算暴露因素的作用
E. 高估暴露因素的作用

正确答案：A。降低研究效率